外伤露髓的年轻恒牙之所以能够进行活髓切断术，其生理基础在于牙髓中存在
A. 成牙本质细胞
B. 成纤维细胞
C. 成牙骨质细胞
D. 未分化间叶细胞
E. 毛细血管细胞

正确答案：D。未分化间叶细胞

解析：牙髓是结缔组织，是有修复再生的能力的，对于新鲜暴露的牙髓，经过适当的临床治疗后，牙髓内的未分化间叶细胞可分化为成牙本质细胞，形成牙本质桥。掌握“牙髓”知识点。